不适用于培养病毒的方法是
A. 适龄鸡胚接种
B. 传代细胞培养
C. 组织器官培养
D. 易感动物接种
E. 人工合成培基

正确答案：E。人工合成培基

解析：病毒分离培养法包括：鸡胚接种、组织培养、动物接种。将离体活组织块或分散的活细胞加以培养，统称为组织培养。组织培养法有三种基本类型，即器官培养、移植培养和细胞培养。掌握“病毒感染检查方法及防治原则”知识点。